不在心腔内的是
A. 窦房结
B. 室间隔
C. 三尖瓣复合体
D. 左、右冠状动脉开口
E. 二尖瓣

正确答案：D。左、右冠状动脉开口

解析：左、右冠状动脉开口（D对）不在心腔内，其开口于升主动脉。